患儿面色㿠白，全身浮肿，按之深陷难起，大便溏薄，神倦畏寒，腰酸肢冷。治疗应首选
A. 己椒苈黄丸
B. 参苓白术散
C. 六君子汤
D. 真武汤
E. 麻黄连翘赤小豆汤

正确答案：D。真武汤

解析：患儿全身浮肿，按之深陷难起，属于水肿范畴，其脾气虚弱，无法运化水湿故见全身浮肿，按之深陷难起，其肾阳虚弱故见面色㿠白，神倦畏寒，腰酸肢冷，大便溏薄，治宜温肾健脾，方用真武汤（D对）。己椒苈黄丸有泻肺逐水之功，可合参附汤治疗水肿之水凌心肺证（A错）。参苓白术散有健脾益气，兼化湿浊之功，可用于治疗水肿之气虚邪恋证（B错）。六君子汤有健脾补肺，益气化痰之功，可用于气虚咳嗽（C错）。麻黄连翘赤小豆汤功可疏风利水，可用于水肿之风水相搏证（E错）。